某男性患者，29岁，体健。诉牙龈自发出血1月，熬夜3天后出血严重并伴有牙龈疼痛和口臭，伴有低热和全身乏力。最可能的诊断是急性坏死性溃疡性龈炎。若诊断为急性坏死性溃疡性龈炎，最有价值的辅助检查是
A. 菌斑涂片
B. X线片
C. 组织病理
D. 免疫化验
E. 查血常规

正确答案：A。菌斑涂片

解析：本题考查急性坏死性溃疡性龈炎的诊断。急性坏死性溃疡性龈炎是在已有的慢性龈炎或牙周炎的基础上由梭形杆菌和螺旋体引起的特殊感染。临床表现结合菌斑涂片（A对）有助于本病的诊断。 X线片（B错）主要用于观察釉质、牙本质等硬组织变化，对牙龈等软组织检查临床意义不大。依据组织病理（C错）改变可以为临床诊断提供依据，但需要做病理切片，对患者损伤大。急性坏死性溃疡性龈炎没有特殊的免疫特征，免疫化验（D错）意义不大。血常规检查（E错）无法检出梭形杆菌和螺旋体，临床意义不大。